固定义齿的特点不包括
A. 咀嚼效率高
B. 修复软组织缺损
C. 稳固耐用
D. （牙合）力由牙周组织承担
E. 舒适美观

正确答案：B。修复软组织缺损

解析：本题考查固定义齿的特点。固定义齿的特点不包括修复软组织缺损（B错，为本题的正确答案）。固定义齿的特点：1.用粘固料将固位体牢固粘固在基牙上，稳固耐用（C对），病人无法自行取戴；2.义齿所受（牙合）力完全由基牙的牙周膜承担（D对），近似天然牙受力方式，咀嚼效率高（A对）；3.义齿体积小，无异物感，舒适美观（E对），但磨削牙体组织较多；4.对基牙的支持和固位能力要求较高，一般只用于修复无显著软、硬组织缺损的非游离端少数牙缺失。